男性，25岁，1年来牙龈逐渐肿大。检查发现：全口牙龈乳头及龈缘肿，上下前牙明显。龈乳头球状突起，前牙龈呈分叶状、质地坚硬，略有弹性，呈粉红色，不出血，无疼痛，龈沟加深，有菌斑，无分泌，11、21部分冠折断，已做根管治疗。上述检查仍不能确诊，在用药史上还需了解的是
A. 全身用药
B. 抗癫痫药物
C. 非激素类药物
D. 抗厌氧菌药物
E. 局部用药

正确答案：B。抗癫痫药物

解析：根据病例中所得到的信息考虑到了药物性牙龈增生，那么按照采集病史的思路需要提问用药史。能导致药物性牙龈增生的有抗癫痫药物、免疫抑制剂和钙通道阻断剂。掌握“药物性牙龈肥大”知识点。